INQ的含义是
A. 热能密度
B. 功效比值
C. 营养素密度
D. 营养质量指数
E. 身体质量指数

正确答案：D。营养质量指数